新生儿，足月顺产，出生体重3000克。1分钟Apgar评分：呼吸0，心率1，皮肤颜色1，弹足底反应1，肌张力1，以下处理措施中，属于初步复苏步骤的
A. 肾上腺素经脐静脉注入
B. 胸外心脏按压
C. 生理盐水扩容
D. 清理呼吸道
E. 气管插管，正压通气

正确答案：D。清理呼吸道

解析：该新生儿Apgar评分：呼吸0，心率1，皮肤颜色1，弹足底反应1，肌张力1，共4分，提示为轻度窒息（P97）。复苏采用国际公认的ABCDE复苏方案：A清理呼吸道；B建立呼吸；C维持正常循环；D药物治疗；E评估。操作时应严格按照A⇀B⇀C⇀D步骤进行复苏。初步复苏即第一步，以清理呼吸道为主（D对），具体步骤包括保暖、摆好体位、清理呼吸道、擦干身体及刺激诱发自主呼吸。气管插管、正压通气（E错）为第二步建立呼吸措施。胸外心脏按压（B错）为第三步维持正常循环措施。肾上腺素经脐静脉注入（A错）、生理盐水扩容（C错）为第四步药物治疗措施。